宜用朱砂拌衣炮制增强安神作用的中药有
A. 茯神
B. 人参
C. 远志
D. 灯心草
E. 竹茹

正确答案：A、C、D。茯神；远志；灯心草

解析：本题考查拌衣的目的。朱砂拌衣后增强安神作用的是茯神（A对）、远志（C对）、灯心草（D对）。拌衣法：将净制或切制后的药物，表面用水湿润，加入定量的辅料使之粘于药物上，晾干的炮制方法，称为拌衣法。拌衣的目的：增强疗效或起到一定的治疗作用。如朱砂拌茯神、茯苓、远志等，增强宁心安神的作用；青黛拌灯心草，有清热凉血的作用。灯心草【炮制作用】灯心草味甘、淡，性微寒。归心、肺、小肠经。具有清心火、利小便的功效。①灯心草生品长于利水通淋。用于心烦失眠，尿少涩痛，口舌生疮。②朱砂拌灯心以降火安神力强。多用于心烦失眠，小儿夜啼。不宜入煎剂。③青黛拌灯心偏于清热凉血。多用于尿血。④灯心炭凉血止血，清热敛疮。外用治咽痹，乳蛾，阴疳。灯心草炭能缩短出血和凝血时间。蒸制：利用水蒸气加热药物（或药物与辅料）的方法。不加辅料蒸制的时间较短，其目的是软化药材，便于切制或使药物便于保存，如清蒸木瓜、天麻、桑螵蛸、黄芩、人参（B错）等。加辅料蒸制的时间相对较长，主要目的在于改变药物性味，产生新的功能，扩大临床适用范围，如酒蒸地黄、大黄，黑豆）蒸何首乌；亦可增强疗效，如酒蒸肉苁蓉、黄精、山茱萸、女贞子、五味子等。姜炙的目的：①制其寒性，增强和胃止呕作用。如黄连、竹茹（E错）等。②缓和副作用，增强疗效。如厚朴等。